《中国药典》中，测定硫酸阿托品片含量的方法是
A. 红外分光光度法
B. 紫外-可见光分光光度法
C. 薄层色谱法
D. 非水溶液滴定法
E. 氧化还原滴定法

正确答案：B。紫外-可见光分光光度法

解析：本题考查硫酸阿托品片的含量测定。《中国药典》中，测定硫酸阿托品片含量的方法是紫外-可见光分光光度法（B对）。